以硅胶为固定相的薄层色谱通常属于
A. 分配色谱
B. 吸附色谱
C. 离子抑制色谱
D. 离子交换色谱
E. 离子对色谱

正确答案：B。吸附色谱